造成药材品种混乱现象的主要原因有
A. 同名异物和同物异名现象
B. 栽培措施不当
C. 本草记载不详
D. 有的中药在不同的历史时期品种发生了变化
E. 一药多基原情况较为普遍

正确答案：A、C、D、E。同名异物和同物异名现象；本草记载不详；有的中药在不同的历史时期品种发生了变化；一药多基原情况较为普遍

解析：本题考查的是药材品种混乱和复杂现象的原因。造成药材品种混乱现象的主要原因有同名异物和同物异名现象（A对）、本草记载不详（C对）、有的中药在不同的历史时期品种发生了变化（D对）、一药多基原情况较为普遍（E对）。当今常用中药八百余种，绝大多数在历代本草中已有记载。由于历史等诸多因素，使中药材品种混乱现象严重，主要原因有：①同物异名，同名异物。②本草典籍，记述粗略。③一药多源，易于混杂。④历史沿革，品种变迁。